男性，25岁。因高位小肠瘘1天入院，入院后经颈内静脉插管滴入肠外营养液，两周后突然出现寒战、高热，无咳嗽、咳痰，腹部无压痛和反跳痛。观察8小时如果仍然有高热应采取的措施是
A. 肠外营养液中增加胰岛素
B. 雾化吸入
C. 胸腔穿刺抽气
D. 拔除中心静脉导管
E. 咽拭子细菌培养

正确答案：D。拔除中心静脉导管

解析：患者因肠瘘而行肠外营养，后出现寒战、高热等全身感染症状，而无咳嗽、咳痰，故其最有可能的诊断为导管性脓毒症。导管性脓毒症的治疗最主要的是拔除中心静脉导管（D对），消除致病菌进入血液循环的根源。肠外营养液中增加胰岛素（A错）只能降低血糖，不能有效改善患者的全身感染症状。雾化吸入（B错）主要用于肺部感染时的治疗措施。胸腔穿刺抽气（C错）是气胸的治疗措施。咽拭子细菌培养（E错）主要用于咽喉部感染时确定致病菌。